通过内囊膝部的传导束是
A. 皮质脊髓束
B. 额桥束
C. 丘脑前辐射
D. 皮质脑干束（皮质核束）
E. 听辐射

正确答案：D。皮质脑干束（皮质核束）

解析：内囊是位于丘脑、尾状核和豆状核之间的白质板，分前肢、膝、后肢三部。经内囊前肢的投射纤维有额桥束（B错）、丘脑前辐射（C错）；经内囊膝的投射纤维有皮质脑干束（皮质核束）（D对）；经内囊后肢的投射纤维有皮质脊髓束（A错）、皮质红核束、顶桥束、视辐射、听辐射（E错）等。